女，59岁，在全身麻醉下行腹膜后肿瘤切除术，术中岀血较多，即刻输注AB型悬浮红细胞2个单位，当输注50ml时，患者岀现发热，畏寒，脉快，血压下降，腰痛，导尿浓茶色，该患者最可能的输血不良反应是
A. 急性溶血性反应
B. 过敏性反应
C. 非溶血性发热反应
D. 细菌汚染性输血反应
E. 慢性溶血

正确答案：A。急性溶血性反应

解析：中年女性患者，在全身麻醉下行腹膜后肿瘤切除术，术中出血较多，即刻输注AB型浓缩红细胞2个单位（输血史），当输注50ml时，患者岀现发热，畏寒，脉快，血压下降，腰痛，导尿浓茶色（急性溶血表现），故该患者最可能的输血不良反应是急性溶血性反应（A对）。过敏性反应（B错）多发生在输血数分钟后，也可在输血中或输血后发生，表现为皮肤局限性或全身性瘙痒或荨麻疹。非溶血性发热反应（C错）多发生于输血开始后15分钟至2小时内。主要表现为畏寒、寒战和高热，体温可上升至39-40°C，同时伴有头痛汗、恶心、呕吐及皮肤潮红。症状持续30分钟至2小时后逐渐缓解.血压多无变化。细菌污染性输血反应（D错）一般于输血后即可出现，轻微者可仅有发热反应，反之则则输入后可立即出现内毒素性休克（如大肠埃希菌或铜绿假单胞菌）和DIC。慢性溶血（E错）多发生在输血后7-14天，表现为原因不明的发热、贫血、黄疽和血红蛋白尿，一般症状并不严重。